对各型癫痫都有效的药物是
A. 乙琥胺
B. 苯妥英钠
C. 地西泮
D. 丙戊酸钠
E. 硫酸镁

正确答案：D。丙戊酸钠